女，25岁。妊娠37周，G₁P₀，因羊膜破裂入院待产。既往身体健康，无传染病及遗传性疾病史。分娩过程顺利，产一男婴7斤重。分娩后突然出现呼吸困难、发绀、抽搐、休克死亡。最可能发生的是
A. 血栓形成
B. 空气栓塞
C. 脂肪栓塞
D. 心肌梗死
E. 羊水栓塞

正确答案：E。羊水栓塞

解析：青年女性，因羊膜破裂入院待产（发生羊水栓塞的病因），分娩后突然出现呼吸困难发绀抽摘休克死亡（羊水栓塞的患者在分娩后不久可出现呼吸困难、发绀、抽搐。病情严重者，产妇仅惊叫一声或打一个哈欠或抽搐一下后呼吸心搏骤停，于数分钟内死亡），该患者最可能发生的是羊水栓塞（E对D错）。在分娩过程中发生血栓形成（A错）、空气栓塞（B错）及脂肪栓塞（C错），虽然也可突然出现呼吸困难发绀抽搐休克死亡等一系列症状，但发生的可能性较小。